最易引起低钾血症的降压药是
A. 美托洛尔
B. 卡托普利
C. 哌唑嗪
D. 硝苯地平
E. 氢氯噻嗪

正确答案：E。氢氯噻嗪

解析：氢氯噻嗪（E对）为噻嗪类利尿剂，通过抑制近端远曲小管对NaCl的重吸收从而产生利尿作用，尿中排出Na⁺、Cl⁻外，K⁺的排泄也增多，长期服用可引起低血钾（P253）。美托洛尔（A错）为选择性β₁受体拮抗剂，不良反应主要是由于增加气道阻力而引起的症状（P253）。卡托普利（B错）为血管紧张素转换酶抑制剂，可使体内缓激肽增多，引起刺激性干咳（P255）。哌唑嗪（C错）为α₁受体阻断剂，副作用较多，主要为体位性低血压（P255）。硝苯地平（D错）为二氢砒啶类钙通道阻滞剂，主要通过阻滞L型钙通道减少钙离子内流，减弱兴奋-收缩偶联，引起阻力血管扩张，主要不良反应有心率增快、面部潮红、头痛、下肢水肿等（P255）。